艾滋病患者不应承担的义务为
A. 配合临床试验
B. 告知性伴侣
C. 告知经治医师
D. 接受疾控中心的流行病学调查
E. 采取必要防护措施

正确答案：A。配合临床试验

解析：艾滋病患者应当履行的义务有:①接受疾病预防控制机构或者出入境检验检疫机构的流行病学调查和指导(D对）;②将感染或者发病的事实及时告知与其有性关系者(B对）;③就医时，将感染或者发病的事实如实告知接诊医生(C对）;④采取必要的防护措施，防止感染他人(E对）｡不包括配合临床试验(A错，为本题正确答案）｡